不属于深龋的临床表现的是
A. 发展到牙本质深层
B. 自发性疼痛
C. 冷热酸甜刺激入洞敏感
D. 食物嵌塞痛
E. 牙髓活力检查正常

正确答案：B。自发性疼痛

解析：深龋：病变进展到牙本质深层，明显的龋洞，腐质多，洞底深、接近髓腔，患牙有明显的遇冷热酸甜刺激敏感症状，也可有食物嵌塞时的短暂疼痛症状，但没有自发性疼痛。掌握“龋病的临床表现与分类”知识点。